多数人认为痛痛病是慢性镉中毒，镉进入人体的主要途径是
A. 饮水
B. 吃鱼
C. 蔬菜
D. 粮食
E. 空气

正确答案：D。粮食

解析：本题考查镉进入人体的主要途径。慢性镉中毒是人群长期暴露于受镉污染的环境，主要是水体与土壤镉污染和由此导致的稻米与鱼贝类食物镉含量增高，造成摄入者体内镉蓄积并超过一定阈值所引起的以肾脏和骨骼损伤为主要中毒表现的环境污染性疾病。痛痛病是典型的慢性镉中毒，镉进入人体的主要途径是粮食（D对ABCE错）。